更年安片的功能是
A. 滋阴养血，补心安神
B. 滋阴清热，除烦安神
C. 疏肝解郁，安定神志
D. 清心养血
E. 滋补肝肾，养血安神

正确答案：B。滋阴清热，除烦安神

解析：本题考查的是更年安片的功能。更年安片的功能是滋阴清热，除烦安神（B对）。更年安片：【功能】滋阴清热，除烦安神。天王补心丸：【功能】滋阴养血，补心安神（A错）。解郁安神颗粒：【功能】疏肝解郁，安神定志（C错）。朱砂安神丸：【功能】清心养血（D错），镇惊安神。坤宝丸：【功能】滋补肝肾，养血安神（E错）。